与成年人相比婴幼儿对硝酸盐更为敏感。其原因之一是婴幼儿的
A. 胃液的pH值较成年人高，有利于硝酸盐还原菌的生长
B. 胃液的pH值较成年人低，有利于硝酸盐还原菌的生长
C. 胃液的pH值较成年人高，不利于硝酸盐还原菌的生长
D. 胃液的pH值较成年人低，有利于亚硝酸盐还原菌的生长
E. 以上都不对

正确答案：A。胃液的pH值较成年人高，有利于硝酸盐还原菌的生长

解析：本题考查婴幼儿对硝酸盐更为敏感的原因。与成年人相比婴幼儿对硝酸盐更为敏感，其原因之一是婴幼儿的胃液的pH值较成年人高，有利于硝酸盐还原菌的生长（A对BCDE错）。硝酸盐还原菌是一种能够产生硝酸盐的细菌，它们能够在高pH环境中更快地繁殖，从而产生更多的硝酸盐。